目前公认的导致四类主要慢性病的最重要的、共同的、可改变的四大行为危险因素不包括
A. 吸烟
B. 赌博
C. 过量饮酒
D. 水果摄入不足
E. 少体力活动

正确答案：B。赌博